女，29岁，半小时前从高处跌落，右下肢疼痛，活动受限。查体：神志清楚，右侧大腿小腿压痛（+），畸形，异常活动。若患者生命征稳定，影像学检查示右股骨干多段粉碎性骨折，右胫腓骨多段骨折、明显移位，右侧坐骨及耻骨支骨折、轻度移位。首选的治疗方法是
A. 外敷中药
B. 石膏管型固定
C. 夹板固定
D. 切开复位内固定
E. 下肢皮牵引

正确答案：D。切开复位内固定

解析：青年女性患者，有高空跌落受伤史，右下肢疼痛、活动受限，右侧大腿小腿压痛（+）、畸形、异常活动（骨折特有体征），影像学检查示右股骨干多段粉碎性骨折，右胫腓骨多段骨折、明显移位，右侧坐骨及耻骨支骨折，结合患者病史、临床表现及影像学表现，应诊断为多发性骨折。患者生命体征平稳，为便于护理和治疗，防止并发症，首选的治疗方法是切开复位内固定（D对）。复位是治疗骨折的首要步骤，也是骨折固定和康复治疗的基础。石膏管型固定（B错）、夹板固定（C错）属于骨折的固定治疗方法；外敷中药（A错）、下肢皮牵引（E错）属于骨折的康复治疗，这两者都不是患者当前首选的治疗方法。